下述疾病最易出现Ⅱ型呼吸衰竭的是
A. 糖尿病酮症酸中毒
B. 慢性阻塞性肺疾病
C. 哮喘急性发作
D. 重症肺炎
E. 肺血栓栓塞

正确答案：B。慢性阻塞性肺疾病

解析：Ⅱ型呼吸衰竭在氧分压降低的同时存在CO₂潴留，系肺泡通气不足所致，最常见的病因是慢阻肺（B对），慢阻肺典型表现是持续不可逆的气道阻塞和气流受限，引起PaO₂降低及CO₂潴留，导致Ⅱ型呼吸衰竭（P135-P136）。糖尿病酮症酸中毒（A错）以高血糖、酮症、酸中毒为主要表现，酸中毒时动脉血氢离子浓度升高时，刺激外周化学感受器，呼吸运动加深加快，肺通气量增加，肺通气增加使CO₂排出增加，过度通气可使呼吸运动受到抑制，所以糖尿病酮症酸中毒引起的呼吸衰竭主要为Ⅰ型呼吸衰竭（P135）。哮喘急性发作（C错）典型症状为发作性伴有哮鸣音的呼气性呼吸困难，哮喘发作时呈阻塞性通气功能障碍表现，可发生Ⅱ型呼吸衰竭，但不是Ⅱ型呼吸衰竭最常见的疾病（P30）。重症肺炎（D错）主要表现为肺组织内炎性渗出、炎细胞浸润以及肺实质病变，主要为肺换气障碍，导致Ⅰ型呼吸衰竭。急性肺栓塞（E错）时栓塞部位肺血流变少，肺泡无效腔量变大，肺内血流重新分布，V/Q比例失调等因素出现低氧血症和代偿性过度通气，导致Ⅰ型呼吸衰竭（P100）。